可选择放射性核素治疗的疾病是
A. 肾上腺皮质功能减退症
B. 原发性甲状旁腺功能亢进症
C. 原发性甲状腺功能亢进症
D. 原发性甲状腺功能减退症
E. 特发性中枢性尿崩症

正确答案：C。原发性甲状腺功能亢进症

解析：放射性核素可以治疗原发性甲状腺功能亢进症（C对），最常用的是¹³¹1。¹³¹I治疗甲亢的机制是¹³¹I被甲状腺摄取后释放出β射线，破坏甲状腺组织细胞（β射线在组织内的射程仅有2mm，不会累及毗邻组织），减少甲状腺激素产生。肾上腺皮质和甲状旁腺形成激素的原料中并无常用的放射性核素可以标记，故肾上腺皮质功能减退症（A错）、原发性甲状旁腺功能亢进症（B错）不能用放射性核素治疗。原发性甲状腺功能减退症（D错）本身甲状腺功能已减退，放射性碘会破坏甲状腺组织，加重甲状腺功能减退。特发性中枢性尿崩症（E错）一般使用去氨加压素治疗，不选用放射性核素。